颌骨X线片显示病变开始下颌体内，溶骨性破坏为主，可有颌骨膨胀、骨膜反应及密质骨断裂的表现，为系统性疾病中的
A. 糖尿病
B. 急性坏死性溃疡性牙周炎
C. 先天愚型
D. 嗜酸性肉芽肿-颌骨体型
E. 嗜酸性肉芽肿-牙槽突型

正确答案：D。嗜酸性肉芽肿-颌骨体型

解析：本题考查嗜酸性肉芽肿。颌骨X线片显示病变开始下颌体内，溶骨性破坏为主，可有颌骨膨胀、骨膜反应及密质骨断裂的表现，为系统性疾病中的嗜酸性肉芽肿-颌骨体型（D对）。嗜酸性肉芽肿又称局限性组织细胞增生症，颌骨的病变X线表现分为牙槽突型及颌骨体型两类。牙槽突型病变从牙槽突开始，沿着牙槽突破坏骨质，类似牙周病样骨质吸收表现。颌骨体型病变常开始于下颌体内，以溶骨性破坏为主，可有颌骨膨胀，骨膜反应及密质骨断裂。